下列哪个不是社区卫生服务的特点
A. 有效、经济
B. 方便
C. 综合
D. 连续
E. 服务态度好

正确答案：E。服务态度好